女，45岁。突发持续性中上腹痛，阵发加重2小时。疼痛向背部放射，频繁呕吐。查体：腹肌紧张，全腹明显压痛和反跳痛，移动性浊音阳性。血WBC15×10⁹/L。ECG示心房颤动。为进一步确诊，最有意义的检查是
A. 诊断性腹腔穿刺
B. 凝血功能
C. B超
D. 腹部X线片
E. 尿三胆

正确答案：A。诊断性腹腔穿刺

解析：中年女性患者，突发持续性中上腹痛，阵发加重2小时，疼痛向背部放射，频繁呕吐。查体：腹肌紧张，全腹明显压痛和反跳痛（腹膜刺激征），移动性浊音阳性（提示腹腔积液），ECG示心房颤动（提示有动脉血栓的可能）。综合该患者的病史及查体，考虑由肠系膜血管栓塞所致的肠梗阻可能性较大。 由于患者腹腔内渗液较多，为明确诊断，应首选诊断性腹腔穿刺（A对），若抽出血性液体即可明确诊断。据该患者临床表现及体征，不排除急性胰腺炎的可能，可对抽出液体进行生化检查，查看有无淀粉酶升高。凝血功能（B错）检测常用于诊断凝血异常，对于诊断肠系膜血管栓塞无重要价值。B超（C错）经济简便易行，但由于腹部胃肠气体的干扰，其诊断准确性常受影响。腹部X线片（D错）常用于诊断空腔脏器穿孔。尿三胆（E错）指尿胆红素、尿胆原和尿胆素，主要用于鉴别不同类型的黄疸，对肠系膜血管栓塞所致肠梗阻的诊断价值不大。